某卫生行政部门对其辖区内甲、乙两民营医院医疗技术人员的业务素质进行考核，在甲医院随机抽取100人，80人考核结果为合格，20人不合格；乙医院随机抽取150人，100人考核结果为合格，50人不合格。若上题中假设检验结果为P<0.01（α＝0.05），则
A. 可认为两个医院医疗技术人员素质考核合格率相同
B. 可认为两个医院医疗技术人员素质考核合格率相差较大
C. 可认为两个医院医疗技术人员素质考核合格率不同
D. 尚不能认为两个医院医疗技术人员素质考核合格率不同
E. 还不能确定两个医院医疗技术人员素质考核合格率有无差别

正确答案：C。可认为两个医院医疗技术人员素质考核合格率不同